躯干四肢深、浅感觉及头面部浅感觉传导路，相同之处是
A. 第1级神经元位置相同
B. 第2级神经元发出的纤维部分交叉
C. 交叉部位一致
D. 都经过中脑脚底
E. 最后1级神经元均位于丘脑腹后核

正确答案：E。最后1级神经元均位于丘脑腹后核

解析：参与头面部的痛温觉和触压觉传导通路的第一级神经元为三叉神经节内假单极神经元。第2级神经元的胞体在三叉神经脊束核和三叉神经脑桥核，它们发出的纤维交叉到对侧。第3级神经元的胞体在背侧丘脑的腹后内侧核。躯干和四肢意识性本体感觉和精细触觉传导路：第1级神经元为脊神经节内假单极神经元（A错）。第2级神经元经白质前连合交叉到对侧（C错），最后终止于背侧丘脑腹后外侧核（E对）。两者第2级神经元发出的纤维全部交叉之对侧（B错），均未经过中脑脚底（D错）。